患者，女，55岁。既往有慢性肾炎病史。近日因劳累后出现恶心、乏力、尿少，面肢浮肿，纳呆，伴腹水、腹胀，舌苔腻，脉沉滑。血压：160/90mmHg，血红蛋白：89g/L，血肌酐：250μmol/L，Ccr：45mL/min。应首先考虑的诊断是
A. 急性肾衰竭脾肾气虚证
B. 慢性肾衰竭气阴两虚证
C. 急性肾衰竭湿热证
D. 慢性肾衰竭湿浊证
E. 慢性肾衰竭水气证

正确答案：E。慢性肾衰竭水气证

解析：患者既往有慢性肾炎病史，近日因劳累后出现恶心、乏力、尿少，血压升高，血肌酐升高，可诊断为慢性肾衰竭。水湿之邪，浸及肌肤，壅滞不行，以致面肢浮肿；脾为湿困，阳气不得舒展，故见纳呆，伴腹水、腹胀；舌苔腻，脉沉滑均为水气证的特点。治法为利水消肿，方药选用五皮饮或五苓散加减（E对）。患者由于慢性肾炎引发，故不是急性肾衰竭（AC错）。慢性肾衰竭气阴两虚证（B错）的特点为面色少华，神疲乏力，腰膝酸软，口干唇燥，饮水不多，或手足心热，大便干燥或稀，夜尿清长。慢性肾衰竭湿浊证（D错）的特点为恶心呕吐，胸闷纳呆，或口淡黏腻，口有尿味。